女，上腹部腹胀4个月,上消化道造影未见异常，此时缓解腹胀最有效的药物是
A. 抑酸药
B. 抗幽门螺旋杆菌药
C. 硝酸甘油
D. 阿司匹林
E. 促胃动力药

正确答案：E。促胃动力药

解析：该患者女，出现上腹部，腹胀的表现，4个月上消化道造影未见异常，结合患者的表现，诊断为功能性消化不良，应给予促胃动力药缓解腹胀（E对），如效果不佳，可联用抑酸药（A错）。杀灭幽门螺杆菌效果较好的抗菌药有克林霉素、阿莫西林、四环素和甲硝唑。根治幽门螺杆菌阳性的溃疡病临床常采用的联合用药有：抑制胃酸分泌药+2个抗菌药、抑制胃酸分泌药+2个抗菌药+铋剂。临床常用的具体药物搭配方案有：质子泵抑制剂＋克拉霉素＋阿莫西林（或甲硝唑）、枸橼酸铋钾＋四环素（或阿莫西林）＋甲硝唑。疗程一般为14天（B错）。硝酸甘油和硝酸异山梨脂的主要作用是扩张静脉，使静脉容量增加、右房压力降低，减轻肺淤血及呼吸困难，另外还能选择性地舒张心外膜的冠状血管，在缺血性心肌病时增加冠脉血流而提高其心室的收缩和舒张功能，解除心衰症状，提高患者的运动耐力（C错）。阿司匹林及其代谢物水杨酸对COX-1和COX-2的抑制作用基本相当，具有相似的解热、镇痛、抗炎作用（D错）。